腮腺炎病毒属于
A. 正黏病毒
B. 肠道病毒
C. 腺病毒
D. 疱疹病毒
E. 副黏病毒

正确答案：E。副黏病毒

解析：腮腺炎病毒是流行性腮腺炎的病原体，只有一个血清型。属于副黏病毒。掌握“正、副黏病毒”知识点。